阴性预测值的定义是
A. 试验检出阴性的人占已知病人总数的比数
B. 试验检出阴性认为无病的人占无病者总数的比数
C. 筛检阳性者中患该病者的可能性
D. 筛检阴性者中真正为非患者的可能性
E. 以上都不对

正确答案：D。筛检阴性者中真正为非患者的可能性